因加入量不同，可引起混悬剂中混悬微粒发生絮凝作用或反絮凝作用的物质是
A. 甘油
B. 糖浆
C. 阿拉伯胶
D. 酒石酸钠
E. 聚维酮

正确答案：D。酒石酸钠

解析：本题考查的是混悬剂的附加剂。因加入量不同，可引起混悬剂中混悬微粒发生絮凝作用或反絮凝作用的物质是酒石酸钠（D对）。为了增加混悬剂的物理稳定性，在制备时需加入能使混悬剂稳定的附加剂，包括润湿剂、助悬剂、絮凝剂和反絮凝剂等。（1）润湿剂：系指疏水性药物制备混悬剂时，常加入以利于分散的附加剂。常用的润湿剂有吐温类、司盘类表面活性剂等。（2）助悬剂：能增加分散介质的黏度、降低微粒的沉降速度，同时能被药物微粒表面吸附形成机械性或电性保护膜，防止微粒间互相聚集或产生晶型转变，或使混悬液具有触变性，从而增加其稳定性的附加剂。常用助悬剂：①低分子助悬剂，如甘油（A错）、糖浆剂（B错）等。②高分子助悬剂，主要分为天然和合成高分子助悬剂。常用的天然高分子助悬剂及其用量分别为阿拉伯胶（C错）5%～15%、西黄蓍胶0.5%～1%、琼脂0.3%～0.5%，此外尚有海藻酸钠、白及胶、果胶等。常用的合成高分子助悬剂有甲基纤维素、羧甲纤维素钠、羟乙纤维素、聚维酮（E错）、聚乙烯醇等，一般用量为0.1%～1.0%，此类助悬剂性质稳定，受pH影响小，但与某些药物有配伍变化。③硅酸类，如胶体二氧化硅、硅酸铝、硅皂土等。（3）絮凝剂与反絮凝剂：加入适量的电解质可使混悬剂中微粒周围双电层形成的ζ电位降低到一定程度，使得微粒间吸引力稍大于排斥力，形成疏松的絮状聚集体，经振摇又可恢复成分散均匀混悬液的现象叫絮凝，所加入的电解质称为絮凝剂。加入电解质后使ζ电位升高，阻碍微粒之间碰撞聚集的现象称为反絮凝，能起反絮凝作用的电解质称为反絮凝剂，加入适宜的反絮凝剂也能提高混悬剂的稳定性。同一电解质可因用量不同起絮凝作用或反絮凝作用，如枸橼酸盐、枸橼酸氢盐、酒石酸盐、酒石酸氢盐、磷酸盐及一些氯化物等。